关于普萘洛尔，哪项错误
A. 阻断突触前膜β₂受体减少去甲肾上腺素释放
B. 减少肾素的释放
C. 长期用药一且病情好转应立即停药
D. 生物利用度个体差异大
E. 能诱发支气管哮喘

正确答案：C。长期用药一且病情好转应立即停药